痢下赤多者，应重用
A. 温药
B. 凉药
C. 血药
D. 气药
E. 寒药

正确答案：C。血药

解析：痢疾为患，不论虚实，肠中总有滞，气血失于调畅，因此消导、去滞、调气、和血行血为治痢的基本方法。痢疾的治疗有“调气则后重自除，行血则便脓自愈”的调气和血治法。故痢疾治疗常用气药、血药（ABE错）。痢下赤多者为热邪伤及血分，故重用血药（C对）（D错）。